根据《处方管理办法》，关于处方书写要求的说法，正确的是
A. 西药与中药饮片可以开具在同一张处方上
B. 中成药与中药饮片可以开具在同一张处方上
C. 药品用法可用规范的中文、英文、拉丁文或者缩写体书写
D. 药品名称可用规范的中文、英文或者拉丁文书写

正确答案：C。药品用法可用规范的中文、英文、拉丁文或者缩写体书写

解析：本题考查的是处方书写。根据《处方管理办法》，关于处方书写要求的说法，正确的是药品用法可用规范的中文、英文、拉丁文或者缩写体书写（C对）。处方书写：处方书写应当符合的规则列举如下：患者一般情况、临床诊断填写清晰、完整，并与病历记载相一致；每张处方限于一名患者的用药。字迹清楚，不得涂改；如需修改，应当在修改处签名并注明修改日期；药品名称应当使用规范的中文名称书写，没有中文名称的可以使用规范的英文名称书写；医疗机构或者医师、药师不得自行编制药品缩写名称或者使用代号；书写药品名称、剂量、规格、用法、用量要准确规范，药品用法可用规范的中文、英文、拉丁文或者缩写体书写（D错），但不得使用“遵医嘱”“自用”等含糊不清字句；药品用法用量应当按照药品说明书规定的常规用法用量使用，特殊情况需要超剂量使用时，应当注明原因并再次签名；处方医师的签名式样和专用签章应当与院内药学部门留样备查的式样相一致，不得任意改动，否则应当重新登记留样备案。中药饮片、中药注射剂要单独开具处方（A错）。西药和中成药可以分别开具处方，也可以开具一张处方，中药饮片应当单独开具处方（B错）。